解救中度有机磷酸酯类中毒可用
A. 阿托品和毛果芸香碱合用
B. 氯解磷定和毛果芸香碱合用
C. 阿托品和毒扁豆碱合用
D. 氯解磷定和毒扁豆碱合用
E. 氯解磷定和阿托品合用

正确答案：E。氯解磷定和阿托品合用